醋酸氟轻松的结构类型是
A. 雌甾烷类
B. 雄甾烷类
C. 二苯乙烯类
D. 黄酮类
E. 孕甾烷类

正确答案：E。孕甾烷类